口腔颌面外科手术全身麻醉特点中不正确的是
A. 麻醉与手术互相干扰
B. 易于保持气道通畅
C. 小儿与老年患者多
D. 手术失血多
E. 麻醉恢复期呼吸道并发症多

正确答案：B。易于保持气道通畅

解析：本题考查口腔颌面外科手术全麻的特点。全身麻醉是指麻醉药物进入人体后，产生可逆性全身痛觉和意识消失，同时伴有反射抑制和一定程度肌松弛的一种状态。由于气管插管的部位与手术野在一起，故不利于气道的通畅（B错，为本题的正确答案）。由于手术和麻醉的位置都在头部故麻醉与手术容易互相干扰（A对）。小儿、老年患者在口腔颌面外科手术中的比例较高（C对）。由于颌面部血运丰富，故术中失血相对较多（D对）。由于口底、下颌骨、喉会厌区以及颈部的严重损伤等影响正常呼吸，故在麻醉恢复期呼吸道并发症多（E对）。